某女，35岁。患滴虫性阴道炎、霉菌检査阳性，症见带下量多，色黄味臭，阴部瘙痒。证属湿热下注导致的带下病，阴痒。治当清热解毒、燥湿止带、杀虫止痒，宜选用的成药是
A. 桂枝茯苓丸
B. 妇科千金片
C. 千金止带丸
D. 益母草胶囊
E. 妇炎平胶囊

正确答案：E。妇炎平胶囊

解析：本题考查的是妇炎平胶囊的功能。患滴虫性阴道炎、霉菌检査阳性，症见带下量多，色黄味臭，阴部瘙痒。证属湿热下注导致的带下病，阴痒。治当清热解毒、燥湿止带、杀虫止痒，宜选用的成药是妇炎平胶囊（E对）。妇炎平胶囊：【功能】清热解毒，燥湿止带，杀虫止痒。桂枝茯苓丸（A错）：【功能】活血，化瘀，消癥。妇科千金片（B错）：【功能】清热除湿，益气化瘀。千金止带丸（C错）：【功能】健脾补肾，调经止带。益母草胶囊（D错）：【功能】活血调经。